患者，女，25岁，已婚。产后恶露量少，少腹阵痛拒按，气粗喘促，不省人事，两手握拳，牙关紧闭，唇舌色紫，脉涩。其证候是
A. 气滞血瘀
B. 肝郁气闭
C. 血热瘀闭
D. 血瘀气闭
E. 肝风内动

正确答案：D。血瘀气闭

解析：患者产后腹痛拒按，恶露量少，唇舌色紫，脉涩是为血瘀之象，气粗喘促，不省人事，牙关紧闭是为气闭之象（D对）。气滞血瘀证除有血瘀之象见证外，还有气滞之象，常见身体局部胀闷走窜作痛，情志抑郁，面色紫黯，闭经或痛经，乳房胀痛等症状（A错）。肝郁气闭常见情志抑郁，胸胁或少腹胀痛，乳房胀痛，月经不调，痛经，舌苔薄白，脉弦症状（B错）。血热瘀闭常见身热口渴，斑疹吐衄，烦躁谵语，舌绛，脉涩症状（C错）肝风内动泛指因风阳，火热，阴血亏虚等所致，以肢体抽搐、眩晕、震颤等为主要表现的证候（E错）。